测量病毒大小的常用单位是
A. 厘米（cm）
B. 毫米（mm）
C. 微米（um）
D. 纳米（nm）
E. 匹米（pm）

正确答案：D。纳米（nm）

解析：病毒的测量单位：因为病毒非常微小，用于测量病毒大小的单位为纳米（nm），1纳米（nm）＝1/1000微米（μm）。各种病毒粒子（病毒体）的直径大小差别悬殊，最大的约300nm，最小的仅20nm，大多数病毒粒子小于150nm。掌握“病毒形态、结构、增殖及影响因素”知识点。